下列哪项是胃的生理功能
A. 水谷精微的转输
B. 水谷的受纳和腐熟
C. 水液的吸收和转输
D. 位置的维系
E. 血液的统摄

正确答案：B。水谷的受纳和腐熟

解析：本题考查脾与胃生理功能的区别，属于理解记忆内容。胃有“太仓”、“水谷之海”之称。胃的主要生理功能是主受纳和腐熟水谷（B对）。脾主运化，是指脾具有把饮食水谷转化为水谷精微（即谷精）和津液（即水精），并把水谷精微和津液吸收、转输到全身各脏腑的生理功能（AC错）。脾主统血，是指脾气有统摄、控制血液在脉中正常运行而不逸出脉外的功能（E错）。脾主升举内脏，是指脾气上升能起到维持内脏位置的相对稳定，防止其下垂的作用（D错）。